以下检测方法中，不能确定目前存在幽门螺杆菌感染的是
A. 胃黏膜组织染色
B. 快速尿素酶试验
C. 幽门螺杆菌培养
D. 13C或14C尿素呼吸试验
E. 血清幽门螺杆菌抗体测定

正确答案：E。血清幽门螺杆菌抗体测定

解析：幽门螺杆菌的检测方法有非侵入性方法如¹³C尿素酶呼气试验（D对）、血清抗幽门螺杆菌抗体检测等和侵入性方法如活组织幽门螺杆菌培养（C对）、组织学检查找幽门螺杆菌（A对）、快速尿素酶试验（B对）等。其中血清抗幽门螺杆菌抗体检测（E错，为本题正确答案）只能判断既往感染，不能确定目前是否存在幽门螺杆菌感染。